男性，35岁。高热，皮肤瘙痒半月，右颈及锁骨上淋巴结肿大，无压痛，互相粘连，血红蛋白90g/L，白细胞10×10⁹/L，中性粒细胞66%，淋巴细胞24%，骨髓涂片找到里-斯细胞。常用的化疗方案是
A. ABVD
B. VDP
C. 羟基脲
D. 瘤可宁
E. HA/DA

正确答案：A。ABVD

解析：患者诊断为霍奇金淋巴瘤，其常用的化疗方案应为ABVD方案（A对）。VDP（P575）（B错）方案为急性淋巴细胞白血病常用的诱导缓解方案；羟基脲（P579）（C错）用于慢粒治疗及降白细胞处理；瘤可宁（P581）（D错）即苯丁酸氮芥，主要用于慢性淋巴细胞白血病的治疗；HA/DA（P576）（E错）为急性髓系白血病常用的诱导缓解方案。按九版内科学观点，本题无正确答案，但给出的参考答案为A。